公正原则不适用于
A. 缴费
B. 床位分配
C. 检查顺序
D. 医疗事故处理
E. 纠纷处理

正确答案：A。缴费

解析：公正原则并非意味着平均分配，对于公民所具有的基本的合理的医疗护理以及获取健康的权利要予以保障，体现人人平等，对于患者超越基本健康权的医疗需求也应予以恰当满足。床位分配（B对）、检查顺序（C对）、医疗事故处理（D对）、纠纷处理（E对）属于基本权利，应人人平等。而超越基本医疗范围的需求应依靠市场调节（A错，为本题正确答案）。